消化性溃疡合并上消化道出血属阴虚血热者，其治法是
A. 泄热凉血
B. 滋阴凉血
C. 健脾摄血
D. 益气补血
E. 益气补肾

正确答案：B。滋阴凉血

解析：消化性溃疡合并上消化道出血属阴虚血热者治宜滋阴凉血（B对）。泄热凉血为肝胃郁热证的治法（A错）。健脾摄血为脾虚不能摄血证的治法（C错）。益气补血为气血两虚证的治法（D错）。益气补肾为肾气不足证的治法（E错）。